牙本质小管扩张呈串珠状是在牙本质龋的
A. 透明层
B. 脱矿层
C. 细菌侵入层
D. 坏死崩解层
E. 病损体部

正确答案：C。细菌侵入层

解析：本题考查牙本质龋。牙本质小管扩张呈串珠状是在牙本质龋的细菌侵入层（C对）。1.牙釉质龋由深层至表层病变可分为四层，即透明层、暗层、病损体部（E错）、表层。2.牙本质龋的病理改变由病损深部向表面分为四层结构：（1）透明层（A错）又称硬化层，为牙本质龋最深层、最早出现的改变，位于病变的底部和侧面，在透射光下呈均质透明状。（2）脱矿层（B错）位于透明层表面，是在细菌侵入之前，酸的扩散所导致的脱矿改变。（3）细菌侵入层位于脱矿层表面，牙本质小管内有细菌侵入，细菌甚至进入牙本质小管分支，显微镜下见，细菌侵犯前沿的形态不规则。随着牙本质小管壁和管间牙本质脱矿的进一步加剧，有机基质包括胶原纤维变性、并被蛋白分解酶分解，管周牙本质破坏，相邻小管相互融合，呈串珠样外观。（4）坏死崩解层（D错）为牙本质龋损的最表层。